关于肺外形的叙述，下列哪项是错误的？
A. 右肺较宽短
B. 左肺较狭长
C. 一尖一底（膈面）
D. 肋面和内侧面（纵隔面）
E. 肺尖高度与锁骨一致

正确答案：E。肺尖高度与锁骨一致

解析：右肺较宽短（A对）。左肺较狭长（B对）。肺有一尖一底（C对）。肺有肋面和内侧面（D对）。肺尖达锁骨内侧1/3段上方2-3cm（E错、为本题正确答案）。